下列哪项不是修复患者主诉的内容
A. 职业
B. 吃饭不香
C. 发音不准
D. 面容苍老
E. 颞下颌关节疼痛

正确答案：A。职业

解析：本题考查修复学病史采集。职业（A错，为本题正确答案）不是修复患者主诉的内容。主诉是患者就诊的主要原因和迫切要求解决的主要问题。修复患者主诉通常是要求修复缺损或者缺失牙，或者是要求改善因牙齿缺失、缺损、变色、外伤等导致的咀嚼、美观或发音功能障碍等。也有患者的主诉是要求解决因旧义齿导致的疼痛不适或者咀嚼、美观功能降低等。